某患者在医院就诊时，被发现患有活动性肺结核，则医师应采取的最合适的处理方法是
A. 指导病人消毒
B. 中长期化疗
C. 短程督导化疗
D. 长期督导化疗
E. 对病人补种卡介苗

正确答案：C。短程督导化疗